急性白血病患者接受化疗期间出现了手指、足趾麻木、腱反射迟钝等不良反应，最有可能导致上述症状的药物是
A. 甲氨蝶呤
B. 曲妥珠单抗
C. 长春新碱
D. 环磷酰胺
E. 巯嘌呤

正确答案：C。长春新碱

解析：本题考查长春新碱。长春新碱（C对）具有神经毒性，主要表现为手指、足趾麻木、腱反射迟钝或消失、外周神经炎。甲氨蝶呤（A错）长期用药可引起咳嗽、气短、肺炎或肺纤维化。曲妥珠单抗（B错）不良反应有心功能不全、胚胎毒性、输注反应等。环磷酰胺（D错）不良反应有骨髓抑制、脱发、口腔炎、中毒性肝炎、皮肤色素沉着、月经紊乱等。巯嘌呤（E错）不良反应有白细胞及血小板减少、胆汁郁积出现黄疸、高尿酸血症等。